正常阴道中优势菌群是
A. 乳酸杆菌
B. 棒状杆菌
C. 大肠杆菌
D. 类杆菌
E. 梭状杆菌

正确答案：A。乳酸杆菌

解析：正常阴道微生物群中，以产生过氧化氢的乳杆菌为优势菌（A对），其将单糖转化为乳酸，维持阴道正常的酸性环境（pH≤4.5，多在3.8～4.4），从而抑制棒状杆菌、大肠杆菌、类杆菌、梭状杆菌等其他病原体生长。